男，56岁，嗜酒。因近3个月疲乏无力、心悸、气促、全身水肿并逐渐加重而住院治疗。经强心、利尿、补充白蛋白、抗感染治疗1周后无效。医生考虑可能是由于缺乏某种营养索所致。建议该男子出院后饮食上应多吃
A. 蔬菜
B. 水果
C. 精白米
D. 马铃薯
E. 瘦肉

正确答案：E。瘦肉